患者，男，53岁，季节性过敏性鼻炎病史5年，3天前，受凉后出现流涕、鼻塞、咳嗽，咳痰，低热，头痛，无胸闷、气短等其他不适，已在医院发热门诊完成了鼻拭子检查，排除了甲型流感和乙型流感，诊断为普通感冒。关于普通感冒患者教育的说法，错误的是
A. 目前尚无特效的抗病毒药物
B. 治疗以对症治疗，缓解症状为主
C. 注意休息，适当补充水分
D. 首选口服药物，避免盲目输液
E. 接种流感疫苗可预防普通感冒

正确答案：E。接种流感疫苗可预防普通感冒

解析：本题考查普通感冒患者教育。接种流感疫苗对普通感冒无效（E错，为本题正确答案），因为导致感冒的病毒及其血清型众多，且RNA病毒核酸与蛋白变异频繁，因此很难研发出感冒疫苗，流感疫苗对普通感冒无效。由于普通感冒目前尚无特效的抗病毒药物（A对），故以对症治疗、缓解症状为主（B对），同时注意休息、适当补充水分（C对）、保持室内空气流通，避免继发细菌感染。感冒患者使用药物治疗时应首选口服药物，避免无根据的盲目静脉补液（D对）。静脉补液仅适用于以下几种情况：①因感冒导致患者原有基础疾病加重，或出现并发症，需要静脉给药；②由于患者严重腹泻或高热导致脱水、电解质代谢紊乱，需补充水和电解质；③由于胃肠不适、呕吐而无法进食，需要通过静脉补液维持身体基础代谢。